HAV的主要传播途径是
A. 呼吸道传播
B. 粪-口途径传播
C. 血液传播
D. 蚊虫叮咬
E. 性接触

正确答案：B。粪-口途径传播

解析：甲型肝炎病毒（HAV）通过污染水源、食物、海产品、食具等，经粪-口途径传播，包括日常生活接触和“脏手”传播，而造成散发、暴发或流行。掌握“甲型肝炎病毒”知识点。